对个别污染源调查时，采样点的设置不应考虑的条件是
A. 工厂生产规模
B. 工人数量
C. 附近地形
D. 有害物质的排放量及高度
E. 当地风向频率

正确答案：B。工人数量

解析：本题考查采样点的设置。对个别污染源调查时，一般以污染源为中心，在其周围不同方位和不同距离的地点设置采样点，主要依据工厂的规模（A对）、有害物质的排放量和排放高度（D对）、当地风向频率（E对）和具体地形（C对），并参考烟波扩散范围、污染源与周围住宅的距离和植物生长情况来布置采样点。采样点的设置不需要考虑工人数量（B错，为本题正确答案）。